重度窒息新生儿推迟喂养，第1天静脉补液的量是
A. 60～90ml/kg
B. 150～180ml/kg
C. 50～60ml/kg
D. 90～120ml/kg
E. 120～150ml/kg

正确答案：C。50～60ml/kg

解析：重度窒息新生儿推迟喂养，以防止而吐物再度引起窒息，第1天静脉补液的量是50～60ml/kg（C对）。小儿第1天静脉补液总量=累计损失量+继续损失量+生理需要量，轻度脱水为90～120ml/kg（D错），中度脱水为120～150ml/kg（E错），重度脱水为150～180ml/kg（B错）。